肺癌早期最易忽略的症状是
A. 咳嗽
B. 咯血
C. 胸痛
D. 发热
E. 短气

正确答案：A。咳嗽

解析：咳嗽为肺癌最常见的症状，早期多为刺激性干咳。因为咳嗽症状的普遍性，而且不是肺癌的特异性症状，往往被患者忽视而耽误了病情（A对）。咯血（B错）、胸痛（C错）、发热（D错）、短气（E错）症状较典型，不易被忽略。